我国推荐碘供给量为
A. 100μg/d
B. 150μg/d
C. 200μg/d
D. 300μg/d
E. 400μg/d

正确答案：B。150μg/d

解析：本题考查我国推荐碘供给量。根据代谢测定，碘的生理需要量成人为100～300μg/d，我国推荐碘供给量为150μg/d”（B对ACDE错）。